空腹听诊出现震水音，可见于
A. 肝硬化腹水
B. 肾病综合征
C. 结核性腹膜炎
D. 幽门梗阻
E. 急性肠炎

正确答案：D。幽门梗阻

解析：震水音是胃内有多量液体及气体存留时，气体和液体撞击所产生的声音。当正常人在餐后或饮入多量液体时可查及震水音；在空腹时，胃已排空而不出现震水音，但幽门梗阻（D对）时，由于胃内容物排空障碍，胃内液体和气体积聚存留，空腹也可出现震水音。肝硬化腹水（A错）、肾病综合征（B错）、结核性腹膜炎（C错）和急性肠炎（E错）一般均不出现明显的胃排空障碍，故空腹听诊不会出现振水音。